属于氮苷类化合物的是
A. 红景天苷
B. 水杨苷
C. 芥子苷
D. 腺苷
E. 牡荆素

正确答案：D。腺苷

解析：本题考查的是按苷键原子分类的苷类分类方式。属于氮苷类化合物的是腺苷（D对）。依据苷键原子的不同可将苷分为O-苷、S-苷、N-苷和C-苷。1.氧苷（O-苷）：以苷元不同，又可分为醇苷、酚苷、氰苷、酯苷和吲哚苷。（1）醇苷：如红景天苷（A错）、毛茛苷、獐牙菜苷。（2）酚苷：如天麻苷、水杨苷（B错）。（3）氰苷：如苦杏仁苷。（4）酯苷：如山慈菇苷A等。（5）吲哚苷：如靛苷。2.硫苷（S-苷）：如萝卜苷、芥子苷（C错）。3.氮苷（N-苷）：如核苷类物质腺苷、鸟苷、胞苷和尿苷，中药巴豆中的巴豆苷。4.碳苷（C-苷）：如牡荆素（E错）、芦荟苷。